急性胰腺炎所致腹痛的常见放射痛部位是
A. 左上臂内侧
B. 左腰背部
C. 下腰骶部
D. 左下颌部
E. 左肩部

正确答案：B。左腰背部

解析：急性胰腺炎突发腹痛多位于左上腹，向左肩及左腰部放射（P457）；急性胰腺炎突发腹痛多位于上腹正中或左上腹，50%患者有向腰背部放射的束带状痛（二版八年制外科学P550）。各版教材对胰腺炎放射痛部位的叙述有一定差别，但各版教材均认同急性胰腺炎常放射至左腰背部（B对）的观点。